关于Na+-Ca2+交换下列哪一项正确？
A. Na+-Ca2+交换是一种耗能的转运方式
B. 单向性转运
C. Na+:Ca2+的转运比例是1:3
D. 通常的转运方向是Na+出细胞而Ca2+入细胞
E. Na+-Ca2+转运比例是3:1

正确答案：E。Na+-Ca2+转运比例是3:1

解析：Na+/Ca2+交换蛋白(Na+/Ca2+)是心肌细胞膜钙转运蛋白之一，在跨膜Na+、Ca2+梯度和膜电位驱动下对细胞内外Na+、Ca2+进行双向转运（B错），Na+-Ca2+转运比例是3:1（C错E对）。